义齿基托下方牙槽嵴严重突出者，最佳处理方法是
A. 局部按摩
B. 观察，局部不进行处理
C. 舌系带延长术
D. 上颌结节修整术
E. 牙槽突修整术

正确答案：E。牙槽突修整术

解析：义齿基托下方牙槽嵴严重突出者，符合牙槽突修整术的适应证。掌握“牙槽外科”知识点。